从区域定点采样所获环境中毒物浓度的结果，可作为
A. 危险因素评价的重要内容
B. 作业者的接触水平
C. 作业者的吸入量
D. 作业者的吸收量
E. 环境污染状态

正确答案：A。危险因素评价的重要内容